营养脑的动脉，直接分支来源于
A. 颈外动脉
B. 锁骨下动脉
C. 颈内、外动脉
D. 颈内动脉
E. 颈内动脉及椎动脉

正确答案：E。颈内动脉及椎动脉

解析：颈内动脉及椎动脉（E对）的直接分支为营养脑的动脉。其中颈内动脉分支分布于视器和脑，椎动脉分支分布于脑和脊髓。